缺铁性贫血的临床表现不包括
A. 乏力、易倦
B. 头晕、头痛
C. 眼花、耳鸣
D. 心悸、气短
E. 口干、口渴

正确答案：E。口干、口渴

解析：缺铁性贫血的一般症状为皮肤和黏膜苍白，疲乏无力（A对），头晕耳鸣（B对），眼花（C对），记忆力减退；严重者可出现眩晕或晕厥，活动后心悸、气短（D对），甚至心绞痛、心力衰竭。尚有恶心呕吐、食欲减退、腹胀、腹泻等消化道症状。因为缺铁性贫血不影响体内水液代谢，因此不会出现口干、口渴（E错，为本题正确答案）的症状。